女，孕38周出生。出生体重2000g，生后1天，吸吮欠佳。乳腺无结节，皮肤毳毛多。该患儿如出现生理性黄疸，可持续多久消退
A. 5～7天消退
B. 7～10天消退
C. 2周消退
D. 2～3周消退
E. 3～4周消退

正确答案：C。2周消退